细菌细胞壁特有的成分是
A. 肽聚糖
B. 外膜
C. 脂蛋白
D. 脂多糖
E. 脂质A

正确答案：A。肽聚糖